目前认为骨结合是
A. 种植体与骨组织之间仅有薄薄的一层结缔组织
B. 种植体与骨组织之间完全没有结缔组织
C. 在生物相容性不良时也能形成
D. 比纤维－骨性结合的种植体成功率要低一些
E. 骨结合的形成与种植体的结构没有关系

正确答案：B。种植体与骨组织之间完全没有结缔组织

解析：骨结合：种植体-骨界面的正常愈合即骨结合。所谓骨结合即指在光学显微镜下埋植在活骨的种植体与骨组织直接接触，其间不存在骨以外的如结缔组织等组织。掌握“牙种植术概论”知识点。